属右心室内结构的是
A. 隔缘肉柱
B. 界嵴
C. 二尖瓣
D. Todaro腱
E. 主动脉隆凸

正确答案：A。隔缘肉柱

解析：隔缘内柱（A对）属于右心室内结构，其构成右心室流入道的下界，有防止心室过度扩张的功能。